是全身浅筋膜的一部分，包绕颈部，颈阔肌在此层内
A. 颈浅筋膜
B. 颈深筋膜浅层
C. 颈深筋膜中层
D. 颈脏器筋膜
E. 椎前筋膜

正确答案：A。颈浅筋膜

解析：颈浅筋膜为全身浅筋膜的一部分，包绕颈部，颈阔肌在此层内。掌握“颈部分区、颈筋膜层次及下颌下三角解剖特点”知识点。